男，38岁。健康体检胸部X线片发现右肺上叶后段直径约2cm高密度结节影，边界欠清楚。查体：T36.5℃，P72次/分。双肺呼吸音清，未闻及干湿性啰音。为明确诊断应首选的检查是
A. PET-CT
B. 肺相关肿瘤标志物
C. 支气管镜
D. 胸部CT
E. 肺功能检查

正确答案：D。胸部CT

解析：患者中年男性，健康体检胸部X线片发现右肺上叶后段直径约2cm高密度结节影（周围型肺癌影像学典型表现），边界欠清楚。查体：T36.5℃（正常腋温36～37℃），P72次/分（正常60～100次/分）。双肺呼吸音清，未闻及干湿性啰音。结合患者体查和影像学检查，怀疑右肺上叶肺癌可能，为明确诊断应首选的检查是胸部CT（D对），高分辨CT可清晰地显示肿瘤分叶、边缘毛刺、胸膜凹陷征，支气管充气征等。PET-CT（A错）即正电子发射体层扫描检查，可以反映肿瘤细胞的侵袭性及生长速度，常用于肺癌及淋巴结转移的定性诊断。肺相关肿瘤标志物测定（B错）（P83）能反映部分患者的病情变化，但其敏感性往往不高。纤维支气管镜（C错）是确诊肺癌的重要检查方法，但纤维支气管镜检查最适宜中央型肺癌的诊断。肺功能检查（E错）主要用于诊断慢性阻塞性肺疾病、支气管哮喘等。